具有兴奋子宫平滑肌作用的理气药，不包括
A. 枳实
B. 枳壳
C. 陈皮
D. 香附
E. 木香

正确答案：D。香附

解析：本题考查的是具有兴奋子宫平滑肌作用的理气药。具有兴奋子宫平滑肌作用的理气药，不包括香附（D错，为本题正确答案）。调节子宫的作用。枳实（A对）、枳壳（B对）、陈皮（C对）、木香（E对）能兴奋子宫。香附有直接抑制子宫平滑肌的作用、可使痉挛的子宫肌松弛，并有微弱的雌激素样作用。